对于戊型肝炎，以下错误的是
A. 其病原体为HEV
B. 以粪-口传播途径为主
C. 经水传播常引起暴发流行
D. 具有明显的家族聚集现象
E. 无明显的季节性

正确答案：E。无明显的季节性